外果皮散有油细胞的中药材是
A. 小茴香
B. 山楂
C. 枳壳
D. 补骨脂
E. 五味子

正确答案：E。五味子